苦杏仁苷水解后的苷元结构不稳定，其进一步分解释放的少量产物而产生镇咳，平喘作用，大剂量会产生中毒症状。按苷元结构分类，苦仁苷属于
A. 氰苷
B. 醇苷
C. 酚苷
D. 吲哚苷
E. 酯苷

正确答案：A。氰苷

解析：本题考查的是苷的分类。苦杏仁苷水解后的苷元结构不稳定，其进一步分解释放的少量产物而产生镇咳，平喘作用，大剂量会产生中毒症状。按苷元结构分类，苦仁苷属于氰苷（A对）。依据苷键原子的不同可将苷分为O-苷、S-苷、N-苷和C-苷。1.氧苷（O-苷）：以苷元不同，又可分为醇苷、酚苷、氰苷、酯苷和吲哚苷。（1）醇苷（B错）：如红景天苷、毛茛苷、獐牙菜苷。（2）酚苷（C错）：如天麻苷、水杨苷。（3）氰苷：如苦杏仁苷。（4）酯苷（E错）：如山慈菇苷A等。（5）吲哚苷（D错）：如靛苷。2.硫苷（S-苷）：如萝卜苷、芥子苷。3.氮苷（N-苷）：如核苷类物质腺苷、鸟苷、胞苷和尿苷，中药巴豆中的巴豆苷。4.碳苷（C-苷）：如牡荆素、芦荟苷。